下列哪项不是采录“既往史”所要求的内容
A. 既往的健康状况
B. 过去患病史
C. 药物食物等过敏史
D. 预防接种情况
E. 是否到过传染病的流行地区

正确答案：E。是否到过传染病的流行地区

解析：个人史包括个人的社会经历：出生地、居住地和居留时间（尤其是传染病疫源地和地方病流行区）（E错，为本题正确答案）、受教育程度、经济生活和业余爱好；职业和工作条件：工种和劳动环境等；习惯和嗜好：起居和卫生习惯、饮食规律与质量等；冶游史：有无不洁姓交、是否患过性病等。既往史包括患者既往的健康状况（A对）和过去曾经患过的疾病（包括各种传染病）（B对）、外伤手术、预防接种（D对）、过敏史（C对）等，尤其是与现病有密切关系的疾病的历史。